除下列哪一项，均为五脏具有的共同特点
A. 实而不能满
B. 藏精气而不泻
C. 可行气于腑
D. 实体性器官
E. 病则多虚证

正确答案：A。实而不能满

解析：五脏内部组织相对充实，共同生理功能是化生和贮藏精气；六腑多呈中空的搅状或管腔形态，共同生理功能是受盛和传化水谷。”所谓五脏者，藏精气而不泻也，故满而不能实；六腑者，传化物而不藏，故实而不能满也（A错，为本题正确选项）。一般来说，病机上“脏病多虚，腑病多实”。脏与腑的关系，是脏腑阴阳表里配合关系，脏行气于腑，腑输精于脏，体现了阴阳表里相输相应的“脏腑相合”关系（BCDE对）。